关于根管预备的逐步后退法，以下说法错误的是
A. 分三段预备，根尖段、根中段、根冠段
B. 根冠段可用2号、3号G型钻预备
C. 扩大针或扩大锉的使用从大号到小号
D. 根中段预备，器械每增加1号插入根管的长度减少1mm
E. 最后须用主尖锉锉平中上段细微台阶

正确答案：C。扩大针或扩大锉的使用从大号到小号

解析：本题考查逐步后退技术。关于根管预备的逐步后退法错误的是扩大针或扩大锉的使用从大号到小号（C错，为本题的正确答案）。根管预备的逐步后退法是指是先用小号器械从根尖开始预备，逐渐用较大的器械向冠方后退预备，即扩大针或扩大锉的使用从小号到大号，且不可跳号。分三段预备（A对），先预备根尖段；再预备根中段，采用后退预备法，即每增大一号挫进入根管的工作长度减少1mm（D对）；最后预备根管中上段，即根冠段，顺序使用G钻2号、3号（B对）。完成三段预备后，要用主尖挫修整根管壁，即错平中上段细微台阶（E对），使根管壁光滑、根管成为连续的锥形。